黄某，2001年10月因医疗事故受到吊销医师执业证书的行政处罚。2002年9月向当地卫生行政部门申请重新注册。卫生行政部门经过审查决定对黄某不予注册，理由是黄某的行政处罚自处罚决定之日起至申请注册之日止不满
A. 1年
B. 2年
C. 3年
D. 4年
E. 5年

正确答案：B。2年

解析：黄某于2001年10月因医疗事故受到吊销医师执业证书的行政处罚，2002年9月向当地行政部门申请重新注册时不满2年（B对），故当地卫生行政部门不予注册。此外不予注册的情况还包括：①不具有完全民事行为能力的；②因受刑事处罚，自刑罚执行完毕之日起至申请注册之日止不满2年的；③甲类、乙类传染病传染期、精神病发病期以及身体残疾等健康状况不适宜或者不能胜任医疗、预防、保健业务工作的；④重新申请注册，经卫生行政部门指定机构或组织考核不合格的；⑤有国务院卫生行政部门规定不宜从事医疗、预防、保健业务的其他情形的。